膀胱刺激征，腰痛发热，肾无慢性改变，最可能的诊断是
A. 急性肾盂肾炎
B. 急性肾小球肾炎
C. 急进性肾小球肾炎
D. 慢性肾小球肾炎
E. 肾病综合症

正确答案：A。急性肾盂肾炎

解析：膀胱刺激征，腰痛发热，肾无慢性改变，结合患者的表现，最可能的诊断是急性肾盂肾炎（A对）。